虚劳患者，短气自汗，声音低怯，时寒时热，平素易于感冒，舌质淡，脉弱。其证候是
A. 肺气虚
B. 脾气虚
C. 肺阴虚
D. 脾阳虚
E. 肾气虚

正确答案：A。肺气虚

解析：肺气不足，表卫不固，故短气自汗，声音低怯；肺气亏虚，营卫失和，故时寒时热；肺主皮毛，肺虚则腠理不密，故平素易于感冒；舌质淡，脉弱，为气虚之征，故诊断为肺气虚证（A对）。脾气虚，其临床表现为饮食减少，食后胃脘不舒，倦怠乏力，大便溏薄，面色萎黄(B错)。肺阴虚，其临床表现为干咳，咽燥，甚或失音，咯血，潮热，盗汗，面色潮红（C错）。脾阳虚，其临床表现为面色萎黄，食少，形寒，神倦乏力，少气懒言，大便溏薄，肠鸣腹痛，每因受寒或饮食不慎而加剧（D错）。肾气虚，其临床表现为神疲乏力，腰膝酸软，小便频数而清，白带清稀，舌质淡，脉弱（E错）。